风热感冒患者宜选用的中成药是
A. 扑感片
B. 伤风感冒颗粒
C. 银柴颗粒
D. 半夏止咳糖浆
E. 午时茶颗粒

正确答案：C。银柴颗粒

解析：本题考查的是风热感冒的方剂应用。风热感冒患者宜选用的中成药是银柴颗粒（C对）。风热感冒【症状】身热较著，微恶风，头胀痛，或咳嗽少痰，或痰出不爽，咽痛咽红，口渴。舌边尖红，苔薄白或微黄，脉浮数。【方剂应用】银翘散、银翘解毒丸、双黄连口服液、桑菊感冒片、感冒清胶囊、柴银口服液。扑感片（A错）用于风寒型感冒、流感所引起的头痛身酸、恶寒发热、喷嚏、流涕、咳痰稀白。伤风感冒颗粒（B错）用于伤风流涕，咳嗽头痛。半夏止咳糖浆（D错）用于风寒咳嗽，痰多气逆。午时茶颗粒（E错）用于感受风寒，恶寒发热，内有食积，或伴有呕吐、泄泻。